女，35岁。左胸持续性闷痛2天，平卧位加重。心电图示aVR导联ST段压低，其余导联ST段凹面向上抬高，血清肌酸磷酸激酶正常。最可能的诊断是
A. 病毒性心肌炎
B. 急性心包炎
C. 急性心肌梗死
D. 扩张型心肌病
E. 变异型心绞痛

正确答案：B。急性心包炎

解析：中年女性患者，左胸持续性疼痛，平卧位加重（急性心包炎可出现心前区疼痛、变换体位加重），心电图示：aVR导联ST段压低，其余导联ST段凹面向上抬高（aVR及V₁导联ST段压低，其余导联ST段弓背向下抬高是急性心包炎的典型特点），血清肌酸磷酸激酶正常（提示无心肌损伤），该患者最可能的诊断是急性心包炎（B对）。病毒性心肌炎（P283）（A错）多有发热、全身倦怠等病毒感染前驱症状，常有心律失常，血清肌酸磷酸激酶升高。急性心肌梗死（P236）（C错）常表现为突发胸痛、血清肌酸磷酸激酶升高，心电图有特征性和动态性变化。扩张型心肌病（P262）（D错）常为慢性起病，临床表现主要为呼吸困难，查体可发现心界扩大；变异型心绞痛（P229）（E错）主要为静息心绞痛，心电图常表现为相应导联ST段抬高。